铅主要贮存在
A. 肾脏
B. 肝脏
C. 肺脏
D. 脾脏
E. 骨骼

正确答案：E。骨骼